可能属于变态反应性疾病的有
A. 沟纹舌
B. 多形渗出性红斑
C. 地图舌
D. 腺性唇炎
E. 口角炎

正确答案：B。多形渗出性红斑

解析：本题考查口腔黏膜变态反应性疾病。多形性红斑（B对）是一种Ⅲ型超敏反应，属变态反应性疾病。沟纹舌（A错）与年龄、全身疾病、地理环境及人种、遗传有关，非变态反应性疾病。地图舌（C错）可能的主要因素有遗传因素、免疫因素、精神心理因素、其他因素有关。腺性唇炎（D错）先天性因素可能为常染色体显性遗传，后天因素包括使用具有致敏物质的牙膏或漱口水、外伤、吸烟、口腔卫生不良、不良情绪、根尖病灶紫外线过度照射等有关。口角炎（E错）是由真菌，细菌，病毒等病原菌微生物引起的炎症。